当前造成人类死亡的第二位原因是
A. 心脑血管疾病
B. 癌症
C. 呼吸系统疾病
D. 糖尿病
E. 高血压

正确答案：B。癌症

解析：本题考查当前造成人类死亡的第二位原因。当前造成人类死亡的第二位原因是癌症（B对ACDE错）。